急性缺血性脑卒中起病3小时内的治疗应选用
A. 低分子右旋糖酐
B. 阿司匹林
C. 低分子肝素
D. 重组人纤维酶原激活剂（r-PA）
E. 巴曲酶

正确答案：D。重组人纤维酶原激活剂（r-PA）

解析：急性缺血性脑卒中起病3小时内的治疗应选用尿激酶、重组人纤溶酶原激活剂（r-PA）（D对）。低分子右旋糖酐（A错）用于血流动力型TIA的扩容治疗。阿司匹林（B错）可用于反复短暂性脑缺血发作和非心源性脑卒中的治疗。低分子肝素（C错）用于心源性栓塞性TIA的抗凝治疗，卒中急性期不推荐使用抗凝治疗。巴曲酶（E错）用于脑卒中的降纤治疗，疗效尚不明确。